嗜肺军团菌最重要的传播途径是
A. 与患者接触
B. 消化道途径
C. 通过吸入带菌飞沫传播
D. 经烧伤创面感染
E. 医源性交叉感染

正确答案：C。通过吸入带菌飞沫传播

解析：嗜肺军团菌为革兰氏阴性需氧菌，细胞内寄生。该菌引起的军团病为流行于夏秋季，主要通过吸入带菌飞沫传播。常见的感染来源为污染的中央空调和冷却塔水系统等，可引起宾馆、医院感染。尚未发现人与人之间直接传播。掌握“军团菌、铜绿假单胞菌及白喉棒状杆菌”知识点。